沟纹舌伴有巨唇、面瘫时称
A. 梅-罗综合征
B. 莱特尔综合征
C. 贝赫切特综合征
D. 灼口综合征
E. 干燥综合征

正确答案：A。梅-罗综合征

解析：本题考查梅-罗综合征。沟纹舌表现为舌背一条或长或短的中心深沟和多条不规则的副沟。当沟纹舌伴有巨唇、面瘫时称梅-罗综合征（A对）。莱特尔综合征（B错）是指包括关节炎、尿道炎和结膜炎的三联征。贝赫切特综合征（C错）即白塞病，为口-眼-生殖器三联征。灼口综合征（D错）是以舌部为主要发病部位，以瘙痒样疼痛为主要表现的一组综合征。干燥综合征（E错）即舍格伦综合征，是一种侵犯外分泌腺体尤以侵犯唾液腺和泪腺为主的慢性自身免疫性疾病。主要表现为口、眼干燥，也可有多器官、多系统损害。